维生素A缺乏的主要表现
A. 眼部及皮肤症状
B. 眼部症状及消化道症状
C. 皮肤症状，消化道症状
D. 泌尿道症状
E. 免疫系统症状

正确答案：A。眼部及皮肤症状